既补气养血，又调经止带的中成药是
A. 四物合剂
B. 益母草膏
C. 更年舒片
D. 乌鸡白凤丸
E. 当归红枣颗粒

正确答案：D。乌鸡白凤丸